女性，30岁。三月来工作累，近3周出现兴趣缺乏，易疲劳、言语少、动作迟缓，有时心慌气急，自觉患了不治之症，给家庭带来很多麻烦。你认为该病人最可能的诊断是
A. 焦虑症
B. 神经衰弱
C. 疑病症
D. 抑郁症
E. 心身疾病

正确答案：D。抑郁症

解析：青年女性，近3周出现兴趣缺乏，易疲劳、言语少、动作迟缓，有时心慌气急，自觉患了不治之症（疑病妄想：患者认为自己患有某种重大疾病或不治之症，即使经过临床检查也不能解除），给家庭带来很多麻烦（无用：认为自己生活的毫无价值，充满失败，一无是处，觉得自己连累了家人和社会，给别人带来的只有麻烦，不会对任何人有用）。根据该患者的发病时间3周（抑郁发作时间通常大于2周）和临床症状（兴趣缺乏、运动性迟滞、情绪低落、抑郁性认知、妄想）和体征，该患者诊断为抑郁症（D对）。焦虑症（P130）（A错）表现为对未来可能发生的、难以预测的某种危险或不幸事件经常担心。疑病症（P18）（C错）患者毫无根据地坚信自己患了某种严重的躯体疾病或不治之症。神经衰弱（P136）（B错）指由于长期处于紧张和压力下，出现精神兴奋和脑力易疲劳，常伴情绪烦躁、易激惹等。心身疾病（P147）(E错）指由于心理、社会因素为主要发病原因，以生理障碍为主要临床表现。